视网膜位于眼球壁最内层，其本质属于神经组织，内有光感受器，可以感知外界光线的强弱和颜色。视网膜
A. 紧贴脉络膜的内面
B. 由视锥和视杆细胞、双极细胞和神经节细胞3层构成
C. 全层均有感光功能
D. 紧邻眼球壁内腔的是视锥、视杆细胞层
E. 视网膜的最外层为色素上皮层

正确答案：E。视网膜的最外层为色素上皮层

解析：视网膜紧贴整个血管膜内面，并非仅紧贴于脉络膜内面（A错），且黄斑除仅有视锥细胞构成，并非全层均由视锥和视杆细胞、双极细胞和神经节细胞3层构成（B错）。视网膜分三部，其中仅脉络膜部有感光功能，并非全层均有感光功能（C错）。视网膜还分两层，最外层为色素上皮层（E对），故色素上皮层是紧邻眼球壁内腔的层次，而非视锥、视杆细胞层（D错）。